苯可引起各种类型的白血病，下列哪种白血病与苯关系最密切
A. 幼淋巴细胞白血病
B. 急性粒细胞性白血病
C. 慢性髓性白血病
D. 慢性粒细胞性白血病

正确答案：B。急性粒细胞性白血病

解析：本题考查与苯关系最密切的白血病。苯可引起各种类型的白血病，以急性粒细胞白血病和急性髓性白血病为多，其中急性粒细胞性白血病（B对ACD错）与苯关系最密切。